血海穴位于
A. 髌骨上缘中点上2寸
B. 髌骨内上缘上2寸
C. 髌骨外上缘上2寸
D. 髌骨内下缘上2寸
E. 髌骨外下缘上2寸

正确答案：B。髌骨内上缘上2寸

解析：血海穴属于足太阴脾经，位于髌骨内上缘上2寸，当股四头肌内侧头的隆起处（B对，ADE错）。髌骨外上缘上2寸为梁丘穴，同样也在屈膝位取（C错）。